分布于黏膜系统的淋巴组织约占机体淋巴组织的
A. 90%
B. 70%
C. 50%
D. 40%
E. 30%

正确答案：C。50%